某女，36岁。近日出现口舌生疮、咽喉疼痛、心胸烦热、小便短赤、大便秘结。医师处以导赤丸治疗，此因该成药的功能是
A. 清热解毒，泻火通便
B. 清热泻火，利尿通便
C. 清热泻火，解毒敛疮
D. 清热解毒，利尿通淋
E. 清热解毒，消肿止痛

正确答案：B。清热泻火，利尿通便

解析：本题考查导赤丸的功能。医师处以导赤丸治疗，此因该成药的功能是该成药的功能是清热泻火，利尿通便（B对）。导赤丸【功能】清热泻火，利尿通便。牛黄至宝丸【功能】清热解毒，泻火通便（A错）。一清颗粒（胶囊）【功能】清热泻火解毒（C错），化瘀凉血止血。三金片（颗粒、胶囊）【功能】清热解毒，利湿通淋（D错），益肾。如意金黄散【功效】清热解毒，消肿止痛（E错）。